儿童注意力缺陷多动障碍的特征不包括
A. 活动过度
B. 手足蠕动
C. 注意力涣散
D. 冲动任性
E. 学习困难

正确答案：B。手足蠕动

解析：儿童注意力缺陷多动障碍即儿童多动综合征，是儿童时期一种较常见的行为异常性疾患，临床以与年龄不相称的注意力不集中（C对），不分场合的动作过多（A对），情绪冲动（D对），可伴有认知障碍和学习困难（E对），但智力正常或基本正常为特征。手足蠕动（B，为本题正确答案）是指手足轻微抽动，由阴血虚，筋脉失养所致，为肝风内动的表现。